男，70岁。右侧肢体动作迟缓伴震颤半年。查体：右侧肢体静止性震颤，肌张力齿轮样增高。病变可能的部位是
A. 大脑皮质
B. 黑质
C. 小脑
D. 内囊
E. 脑桥

正确答案：B。黑质

解析：本例患者老年男性，右侧肢体动作迟缓伴震颤半年。查体：右侧肢体静止性震颤，肌张力齿轮样增高（肌强直），可诊断为帕金森病，帕金森病的主要病理改变是黑质-纹状体多巴胺能通路变性，故该患者病变可能的部位是黑质（B对）。大脑皮质（A错）损害表现为皮质反应区相应部位的功能障碍。小脑（E错）病损主要表现为共济失调。内囊（D错）损害表现为偏瘫、偏身感觉障碍及偏盲等“三偏”综合征。脑桥（E错）病损可出现眼球不能外展、眩晕、呕吐、面肌麻痹、偏瘫等一系列症状。